下列哪种休克的治疗比较复杂
A. 心源性休克
B. 低血容量性休克
C. 感染性休克
D. 过敏性休克
E. 神经源性休克

正确答案：C。感染性休克

解析：感染性休克常继发于胆道感染、绞窄性肠梗阻、大面积烧伤、急性弥漫性腹膜炎、脓毒症，是以释放内毒素的革兰阴性杆菌为主的感染。感染性休克的病理生理变化比较复杂，故治疗比较困难。掌握“休克”知识点。